男，35岁。头部外伤后昏迷1小时，出现右侧肢体瘫痪，后逐渐好转。头颅CT示颅内有散在高密度影。应考虑为
A. 脑内血肿
B. 急性硬脑膜外血肿
C. 急性硬脑膜下血肿
D. 脑震荡
E. 脑挫裂伤

正确答案：E。脑挫裂伤

解析：青年男性患者，头部外伤后昏迷、右侧肢体瘫痪后好转（脑挫裂伤的表现），头颅CT示颅内有散在高密度影（脑挫裂伤的典型影像学表现），结合患者病史、临床表现和影像学检查，应诊断为脑挫裂伤（E对）。脑内血肿（P194）（A错）CT表现为脑组织内类圆形或不规则的高密度影。急性硬脑膜外血肿（P191）（B错）CT表现为颅骨内板与硬脑膜之间的双凸镜形高密度影。急性硬脑膜下血肿（P192）（C错）CT表现为脑表现新月形高密度影。脑震荡（P188）（D错）是最轻微的脑损伤，主要表现为伤后立即发生的短暂意识障碍和近事遗忘，头颅CT多无无阳性发现。